青年男性最多见的继发性肾病
A. 过敏性紫癜肾炎
B. 淋巴瘤性肾病
C. 糖尿病肾病
D. 肾淀粉样变
E. 骨髓瘤性肾病

正确答案：A。过敏性紫癜肾炎

解析：过敏性紫癜肾炎是青年男性最多见的继发性肾病（A对）。